石膏的性味是
A. 辛苦大寒
B. 辛咸大寒
C. 辛酸大寒
D. 辛甘大寒
E. 甘淡大寒

正确答案：D。辛甘大寒

解析：该题考查石膏的药性，属记忆内容。石膏药性 甘、辛，大寒（D对）。